某男，75岁。胸闷心痛，倦怠乏力，腹胀脘瘩，形体肥胖，舌体胖大有齿痕，苔浊腻，脉滑。诊断为胸痹，证属痰凝闭阻、阳气被遏，宜选用的中成药是
A. 冠心丹参滴丸
B. 稳心颗粒
C. 血滞通胶囊
D. 益心胶囊
E. 冠心苏合滴丸

正确答案：C。血滞通胶囊

解析：本题考查胸痹之痰浊痹阻证的中成药应用。诊断为胸痹，证属痰凝闭阻、阳气被遏，宜选用的中成药是血滞通胶囊（C对）。胸痹之痰浊痹阻证【症状】胸闷重而心痛微，痰多气短，肢体沉重，形体肥胖，遇阴雨天而易发作或加重，伴有倦怠乏力，纳呆便溏，咳吐痰涎。舌体胖大且边有齿痕，苔浊腻或白滑，脉滑。【中成药应用】常用中成药为血滞通胶囊、丹蒌片、舒心降脂片、降脂通络软胶囊。胸痹之气滞血瘀证【症状】心胸疼痛，如刺如绞，痛有定处，入夜为甚，重者心痛彻背，背痛彻心，或痛引肩背，伴有胸闷，日久不愈，可因暴怒、劳累而加重。舌质紫暗，有瘀斑，苔薄，脉弦细。【中成药应用】常用中成药为血府逐瘀口服液、速效救心丸、复方丹参滴丸、冠心丹参滴丸（A错）、银丹心脑通软胶囊。心悸之瘀阻心脉证【症状】心悸不安，胸闷不舒，心痛时作，痛如针刺，唇甲青紫。舌质紫暗或有瘀斑，脉涩或结或代。【中成药应用】常用中成药为血府逐瘀口服液、七叶神安片、稳心颗粒（B错）、参松养心胶囊。胸痹气阴两虚证【症状】胸闷隐痛，时作时止，心悸气短，动则益甚，伴倦怠懒言，易汗出，头晕，失眠多梦。舌红或淡红，舌体胖且边有齿痕，苔薄白或少，脉细缓或结代。【中成药应用】常用中成药为益心胶囊（D错）、益心舒胶囊、益心通脉颗粒、冠心生脉口服液、洛布桑胶囊。胸痹之寒凝心脉证【症状】猝然心痛如绞，心痛彻背，喘不得卧，多因气候骤冷或骤感风寒而发病或加重，伴形寒，甚则手足不温，冷汗自出，胸闷气短，心悸，面色苍白。舌质紫暗，或有瘀斑瘀点，苔薄，脉沉紧或沉细。【中成药应用】常用中成药为宽胸气雾剂、苏合香丸、冠心苏合滴丸（E错）、神香苏合丸（庆余救心丸）。